男性，62岁。近两月来常有吞咽困难，伴隐痛，但可进半流质饮食，自感体力不支，逐渐消瘦。对诊断最有价值的检查是
A. 胸部X线片
B. 食管吞钡
C. 食管拉网
D. 纤维食管镜+活检
E. 纵隔CT

正确答案：D。纤维食管镜+活检

解析：老年男性患者，吞咽困难（提示食管疾病），伴隐痛，逐渐消瘦、体力不支（提示恶病质），结合患者病史及临床表现，该病人首先考虑的诊断是食管癌。为明确诊断，最有价值的检查是纤维食管镜+活检（D对），此为诊断的金标准。胸部X线片（A错）、纵隔CT（E错）均为影像学检查，只能辅助食管癌的诊断，不能确诊。食管吞钡（B错）检查对食管癌的诊断有一定价值，但准确性不及病理检查。食管拉网（C错）主要用于食管癌的筛查。